关于发育曲线图法的描述哪一项是错误的
A. 单项发育指标的等级
B. 多项发育指标的等级
C. 单项发育指标多年来随年龄增加的变动趋势
D. 单项发育指标的发育速度、年增加值
E. 个体儿童发育水平及几年中某发育指标的变化趋势

正确答案：B。多项发育指标的等级